半夏反
A. 甘草
B. 瓜蒌
C. 乌头
D. 白及
E. 大戟

正确答案：C。乌头

解析：乌头（C对）（包括川乌、草乌、附子）反浙贝母、川贝母、瓜蒌（B错）、天花粉、半夏、白及（D错）、白蔹；甘草（A错）反海藻、京大戟、红大戟（E错）、甘遂、芫花；藜芦反人参、西洋参、党参、丹参、玄参、北沙参、南沙参、苦参、细辛、白芍、赤芍。